比较理想的表面麻醉剂是
A. 普鲁卡因
B. 利多卡因
C. 地卡因
D. 可卡因
E. 氯乙烷

正确答案：C。地卡因

解析：丁卡因：又名地卡因，穿透力强。临床上主要用作表面麻醉。麻醉作用较普鲁卡因强10倍。由于毒性大，一般不作浸润麻醉，即使用作表面麻醉，亦应注意剂量。一次使用量不应超过40～60mg，即2%丁卡因不超过2ml。掌握“颌面部常用局部麻醉药物”知识点。